几乎所有的慢性闭锁性牙髓炎患者都肯定具有的病史是
A. 有剧烈的自发性疼痛史
B. 有长期的定时钝痛史
C. 有长期的冷、热刺激痛史
D. 有长期的咬合不适或轻度叩痛史
E. 有长期的阵发性隐痛史

正确答案：C。有长期的冷、热刺激痛史

解析：本题考查慢性闭锁性牙髓炎的症状。慢性闭锁性牙髓炎患者的患牙髓腔未穿通，牙髓尚未暴露，病程长，几乎所有患者都有长期的冷、热刺激痛史（C对）。急性牙髓炎或慢性牙髓炎急性发作患者有剧烈的自发性疼痛史（A错）。慢性牙髓炎病程较长，有长期的阵发性隐痛史（E错）或有长期的定时钝痛史（B错）。慢性根尖周炎有长期的咬合不适或轻度叩痛史（D错）。